有关氟斑牙描述不正确的是
A. 一种特殊的牙形态发育异常
B. 一般发生在恒牙
C. 具有对称性
D. 是一种地区流行病
E. 上前牙唇侧最明显

正确答案：A。一种特殊的牙形态发育异常

解析：氟牙症又称氟斑牙或斑釉牙。氟牙症是氟摄入量过高引起的一种特殊类型的釉质发育不全。掌握“氟牙症”知识点。